目前菌痢的病原治疗首选
A. 氯霉素
B. 四环素
C. 磺胺药
D. 呋喃唑酮
E. 氟喹诺酮类

正确答案：E。氟喹诺酮类

解析：喹诺酮类抗菌活性强，口服吸收好，耐药菌株相对较少，毒副作用小，可作为首选药物。如环丙沙星、左氧氟沙星、加替沙星等，但动物实验显示本药可影响骨骺发育，故儿童、孕妇及哺乳期妇女如非必要不宜使用（E对）。